对脑血管具有较强扩张作用的钙拮抗药是
A. 维拉帕米
B. 硝苯地平
C. 尼莫地平
D. 地尔硫䓬
E. 加洛帕米

正确答案：C。尼莫地平

解析：血管平滑肌的肌浆网的发育较差，血管收缩时所需要的Ca²⁺主要来自细胞外，故血管平滑肌对钙通道阻滞剂很敏感，其中对脑血管具有较强扩张作用的钙拮抗药是尼莫地平（C对），可预防由蛛网膜下腔出血引起的脑血管痉挛及脑栓塞。